外用糖皮质激素作用强度比较，正确的是
A. 地塞米松＞氟轻松＞卤米松
B. 卤米松＞地塞米松＞氟轻松
C. 地塞米松＞卤米松＞氟轻松
D. 卤米松＞氟轻松＞地塞米松
E. 氟轻松＞卤米松＞地塞米松

正确答案：D。卤米松＞氟轻松＞地塞米松

解析：本题考查糖皮质激素。外用糖皮质激素作用强度比较，正确的是卤米松＞氟轻松＞地塞米松（D对）。根据外用糖皮质激素的药理作用强度大致可分为弱效、中效、强效和超强效四类。弱效：醋酸氢化可的松。中效：醋酸地塞米松、丁酸氢化可的松、醋酸曲安奈德。强效：糠酸莫米松、二丙酸倍氯米松、氟轻松、0.025%哈西奈德。超强效：卤米松、0.1%哈西奈德、丙酸氯倍他索。即超强效的卤米松＞强效的氟轻松＞中效的地塞米松。